哪样不是OLP的组织病理表现
A. 错角化或不典型增生
B. 上皮过角化
C. 不全角化
D. 基底细胞液化变性
E. 固有层结缔组织中有密集的淋巴细胞浸润带

正确答案：A。错角化或不典型增生

解析：本题考查扁平苔藓的病理变化。错角化或不典型增生（A错，为本题的正确答案）不是OLP的组织病理表现。扁平苔藓（OLP）是一种慢性的口腔黏膜慢性炎症，皮肤和黏膜可同时发病，好发于中年女性，为癌前状态。典型病理表现为：扁平苔藓的基本病变过程是T淋巴细胞聚集于上皮和结缔组织交界处，并引发基底层细胞的破坏。最具特征性的病理改变是基底细胞液化变性（D对）和淋巴细胞在紧邻上皮的固有层呈带状浸润。表面上皮在长期炎症的作用下，可出现多种形态变化，一般炎症较轻时上皮增生、过度角化，炎症破坏较重时则出现上皮萎缩、糜烂和溃疡。镜下观察，可见上皮表面过度角化（B对），以不全角化多见（C对）；棘层可增生、萎缩或两者并存，以增生多见；上皮钉突可以消失，也可呈不规则延长，有时变尖呈锯齿状；基底层细胞空泡性变和液化变性，基底膜和基底细胞层模糊不清，有时甚至形成上皮下疱；在基底层和固有层交界区可见散在或成簇的嗜伊红胶样小体，是凋亡的基底层细胞；固有层见密集的淋巴细胞浸润带（E对），局限于上皮下方，一般不累及黏膜下层；另外，常可见淋巴细胞游走至上皮细胞间，这些细胞与基底细胞的破坏直接相关。免疫组织化学研究显示上皮及固有层淋巴细胞比例（T4/T8）增高。